女性，35岁。发现舌背白色病损4个月，检查发现其舌背左侧约0.5cm×0.5cm白色角化病损，边界不清楚，表面光滑略呈淡紫色。患者发病前有精神创伤史，下肢皮肤有多角形紫红色丘疹，表面有Wickham纹。分析该患者的诊断可能是
A. 白斑
B. 扁平苔藓
C. 白色角化症
D. 地图舌
E. 盘状红斑狼疮

正确答案：B。扁平苔藓

解析：主要特征为珠光白色丘疹或条纹。白纹可交织成网状，或呈树枝状，也可为单线条或绕成环形。损害往往具有明显的左右对称性，黏膜柔软，弹性正常，但有粗糙感，轻度刺激痛。扁平苔藓皮肤损害特点为扁平面有光泽的浅紫红色多角形丘疹，丘疹如绿豆大小，边缘境界清楚，质地坚硬干燥，融合后状如苔藓。损害区粗糙，丘疹间可见皮肤皱褶，由于瘙痒故多有搔痕。以石蜡油涂在丘疹表面，在放大镜下观察可看到有细白纹，称Wickham纹。掌握“口腔扁平苔藓”知识点。